七情刺激，易导致心气涣散的是
A. 喜
B. 怒
C. 悲
D. 恐
E. 惊

正确答案：A。喜

解析：脏腑之气的运动变化在情志活动中发挥着重要的变化七情中过度喜乐伤心，会导致心气涣散不收（A对）。怒则气上：过怒导致肝气疏泄太过，气机上逆，甚则血随气逆，并走于上的病机变化所以（B错）。悲则气消：是指过度悲忧伤肺，导致肺失宣降及肺气耗伤的的病机变化所以（C错）。恐则气下：是指过度恐惧伤肾，致使肾气失固，气陷于下的病及变化所以（D错）。惊则气乱：是指猝然受惊伤心，导致心神不定，气机逆乱的病及变化所以（E错）。